引起脓胸最常见的病原菌是
A. 肠球菌
B. 肺炎链球菌
C. 溶血性链球菌
D. 流感嗜血杆菌
E. 金黄色葡萄球菌

正确答案：E。金黄色葡萄球菌

解析：金黄色葡萄球菌肺炎病理改变以肺组织广泛出血性坏死和多发性小脓脓气胸肿 ，故易形成脓胸、脓气胸（E对）。肠球菌（A错）、肺炎链球菌（B错）、溶血性链球菌（C错）、流感嗜血杆菌（D错）不导致肺组织坏死，很少出现脓胸。